对肛管内结构的描述，错误的是
A. 肛管上段内面的纵行黏膜皱襞称肛柱
B. 相邻两肛柱下端有半月形的黏膜皱襞，称肛瓣
C. 肛瓣的边缘与肛柱的下端共同围成齿状线
D. 齿状线是肛门内、外括约肌的分界线
E. 无

正确答案：D。齿状线是肛门内、外括约肌的分界线

解析：肛管内壁上纵行的黏膜皱襞为肛柱(A对)，相邻两肛柱下端有半月形的黏膜皱襞，称肛瓣(B对)，肛瓣的边缘与肛柱的下端共同围成齿状线(C对)，白线是肛管中下部交界线，正对内括约肌下缘与外括约肌皮下部的交界处(D错，为本题正确答案)。